AIDS的主要传播途径是
A. 性接触、呼吸道传播、消化道传播
B. 性接触、垂直传播、血液传播
C. 性接触、血液传播、呼吸道传播
D. 性接触、消化道传播、血液传播
E. 性接触、垂直传播、呼吸道传播

正确答案：B。性接触、垂直传播、血液传播